龈缘和龈乳头呈轻度炎症，轻探龈沟后不出血，SBI记分为
A. 0
B. 1
C. 2
D. 3
E. 4

正确答案：B。1

解析：本题考查牙周病流行病学及分级预防。1）龈沟出血指数(SBI)：0=龈缘和龈乳头外观健康，探诊龈沟后不出血；1（B对）=龈缘和龈乳头探诊出血，无颜色改变，无肿胀；2=龈缘和龈乳头探诊出血，有颜色改变，无肿胀；3=龈缘和龈乳头探诊出血，有颜色改变，轻微肿胀；4=龈缘和龈乳头探诊出血，有颜色改变，明显肿胀；5=探诊出血，有自发性出血，颜色改变，显著肿胀，有时有溃疡。